男，8岁。足部刺伤1小时，己接受计划性混合疫苗注射，为预防破伤风，最重要的正确的处置是
A. 刺伤部切开不予缝合
B. 注射TAT750U
C. 注射TAT1500U
D. 注射TAT3000U
E. 注射破伤风类毒素0.5ml

正确答案：E。注射破伤风类毒素0.5ml

解析：破伤风是可以预防的疾患。一方面创伤后应早期彻底清创，改善局部循环；另一方面应通过人工免疫，产生较稳定的免疫力。接受全程主动免疫者，伤后仅需肌内注射0.5ml类毒素（E对），即可在3～7天内形成有效的免疫抗体，不需注射破伤风抗毒素（TAT）（BCD错）。而伤前未接受主动免疫的伤员，应尽早皮下注射注射TAT1500～3000U。刺伤部切开不予缝合（A错）意在破坏破伤风梭菌所需的厌氧环境，减少被感染的可能性，并不能从根本上预防。